全世界应用最广泛的疾病分类系统是
A. 明尼苏达（minnesota）编码
B. 国际疾病分类法（ICD）
C. 国际初级卫生保健问题分类（ICHPPC）
D. 损伤、病废和疾病的国际分类（ICIDH）
E. 以上都不是

正确答案：B。国际疾病分类法（ICD）

解析：本题考查公认的疾病分类系统。国际疾病分类（B对ACDE错），根据ICD-10确定伤害的分类是目前国际上比较公认和客观的伤害分类方法。